含不同羟基的黄酮类化合物的酸性强弱顺序是
A. 7，4'-二羟基＞7-羟基＞5-羟基＞一般酚羟基
B. 7，4'-二羟基＞一般酚羟基＞5-羟基＞7-羟基
C. 7，4'-二羟基＞4'-羟基＞一般酚羟基＞5-羟基
D. 7，4'-二羟基＞5-羟基＞7-羟基＞一般酚羟基
E. 一般酚羟基＞7-羟基＞5-羟基＞7，4'-二羟基

正确答案：C。7，4'-二羟基＞4'-羟基＞一般酚羟基＞5-羟基

解析：本题考查的是黄酮类化合物的酸性。含不同羟基的黄酮类化合物的酸性强弱顺序是7，4'-二羟基＞4'-羟基＞一般酚羟基＞5-羟基（C对）。黄酮类化合物的酸性：多数黄酮类化合物因分子中具有酚羟基，故显酸性，可溶于碱性水溶液、吡啶、甲酰胺及二甲基甲酰胺等有机溶剂中。由于酚羟基数目及位置不同，酸性强弱也不同。以黄酮为例，其酚羟基酸性强弱顺序依次为：7，4'-二羟基＞7-二羟基或4'-羟基＞一般酚羟基＞5-羟基。